有关法定职业病的种类和数量，下列哪种说法是正确的
A. 恒定不变
B. 随时变化
C. 越来越少
D. 越来越多
E. 随着不同时期的经济条件和科学技术水平而发生相应的变化

正确答案：E。随着不同时期的经济条件和科学技术水平而发生相应的变化